使用甲苯法测定水分的中药材是
A. 黄连
B. 当归
C. 木瓜
D. 冬虫夏草
E. 金钱草

正确答案：B。当归

解析：本题考查的是水分测定法中甲苯法的适用条件。使用甲苯法测定水分的中药材是当归（B对）。当归主要含有挥发油等成分，可用甲苯法测定水分。《中国药典》规定水分测定法有五种：第一法（费休氏法）包括容量滴定法和库仑滴定法。第二法（烘干法）适用于不含和少含挥发性成分的药品，如三七、广枣等。第三法（减压干燥法）适用于含挥发性成分的贵重药品，如厚朴花、蜂胶等。第四法（甲苯法）适用于含挥发性成分的药品，如肉桂、肉豆蔻、砂仁等。第五法（气相色谱法），如辛夷。当归有机酚酸的化学结构：当归中主要含有有机酸类成分、挥发油和多糖类成分。有机酸类成分主要包括阿魏酸、香草酸、烟酸和琥珀酸等。《中国药典》以阿魏酸和挥发油为指标成分进行含量测定，要求阿魏酸含量不得少于0.050%，挥发油含量不得少于0.4%（ml/g）。